亚急型克山病高发年龄组人群
A. 2～6岁组儿童
B. 10～20岁组男性
C. 10～20岁组女性
D. 老年男性人群
E. 老年女性人群

正确答案：A。2～6岁组儿童

解析：本题考查亚急型克山病高发年龄组人群。克山病是一种以心肌变性坏死为主要病理改变的生物地球化学性疾病。临床可分为急型、亚急型、慢型和潜在型克山病。其中亚急型克山病高发年龄组人群为2～6岁组儿童（A对BCDE错）。主要表现为心脏扩大、水肿，常在数日内发生心力衰竭，可合并心源性休克。